在心动周期中，心室内压力上升速率最快的时期是
A. 等容收缩期
B. 快速射血期
C. 减慢射血期
D. 等容舒张期
E. 快速充盈期

正确答案：A。等容收缩期